属钙通道阻滞剂的药物是
A. 马来酸依那普利
B. 盐酸哌唑嗪
C. 氯沙坦
D. 盐酸地尔硫䓬
E. 利血平

正确答案：D。盐酸地尔硫䓬

解析：本题考查地尔硫䓬。盐酸地尔硫䓬（D对）是苯硫氮䓬类钙通道阻滞剂，可用于治疗心绞痛。马来酸依那普利（A错）是血管紧张素转换酶（ACE）抑制剂，可用于抗高血压。氯沙坦（C错）是血管紧张素Ⅱ受体拮抗剂，可用于抗高血压。盐酸哌唑嗪（B错）是α₁肾上腺素受体拮抗剂，用于轻中度高血压。利血平（E错）是吲哚类生物碱，可用于高血压。